诊断缺铁最肯定的依据是
A. 慢性失血史
B. 小细胞低色素性贫血
C. 转铁蛋白饱和度降低
D. 血清铁降低
E. 骨髓小粒可染铁消失

正确答案：E。骨髓小粒可染铁消失

解析：诊断缺铁最肯定的依据是贮存铁减少，反映贮存铁的指标有血清铁蛋白、骨髓铁。骨髓铁染色是诊断缺铁性贫血最可靠的方法之一，表现为骨髓小粒可染铁消失（E对）。慢性失血史（A错）是引起缺铁的病因；小细胞低色素性贫血（B错）除见于缺铁性贫血外，还可见于铁粒幼细胞性贫血、慢性病性贫血、转铁蛋白缺乏症等疾病；转铁蛋白饱和度降低（C错）、血清铁降低（D错）还可见于慢性病性贫血，均不是诊断缺铁最肯定的依据。